体内糖、脂肪、氨基酸彻底氧化的共同途径是通过
A. 糖酵解途径
B. 三羧酸循环
C. 磷酸戊糖途径
D. 糖原合成途径
E. 糖异生途径

正确答案：B。三羧酸循环

解析：本题考查糖的代谢。体内糖、脂肪、氨基酸彻底氧化的共同途径是通过三羧酸循环（B对）。三羧酸循环是需氧生物体内普遍存在的环状代谢途径。因为此代谢途径中有几个中间代谢物具有三个羧基，故称三羧酸循环。此途径在真核细胞的线粒体中进行，催化每一步反应的酶均位于线粒体内。循环的第一步反应是乙酰辅酶A的乙酰基（2碳化合物）与草酰乙酸（4碳化合物）缩合生成柠檬酸（6碳化合物），后者经异构化并脱氢、脱羧生成α-酮戊二酸（5碳化合物），再脱氢、脱羧生成琥珀酸（4碳化合物）。琥珀酸进一步经两次脱氢、一次水化又重新生成草酰乙酸。草酰乙酸又可和另1分子乙酰辅酶A作用再生成柠檬酸，这样就形成了一个循环。是三大营养物质分解产能的共同通路；是糖、脂肪、氨基酸代谢联系的枢纽。